产后出血最常见的病因是
A. 子宫收缩乏力
B. 胎盘滞留
C. 急性肝炎
D. 软产道损伤
E. 血液系统疾病

正确答案：A。子宫收缩乏力

解析：产后出血（P211）是指胎儿娩出后24小时内失血量超过500ml，剖宫产时超过1000ml，是分娩期的严重并发症，居我国产妇死亡原因首位。子宫收缩乏力、胎盘因素、软产道裂伤及凝血功能障碍是产后出血的主要原因。其中，子宫收缩乏力是产后出血最常见的原因（A对）。